先天缺牙可分为
A. 个别缺牙、部分缺牙、全口缺牙
B. 缺牙症、少牙症、无牙症
C. 上颌缺牙、下颌缺牙、全口缺牙
D. A和B都对
E. A和C都对

正确答案：D。A和B都对

解析：本题考查先天缺牙。先天缺牙是在牙胚形成过程中未能发育和未形成牙齿的，或是发生在牙胚发育早期，即牙蕾形成期的先天性异常。按照缺失牙齿的数目，先天缺牙可分为个别牙缺失、多数牙缺失和先天无牙症（A对）。个别牙缺失又叫缺牙症，部分牙缺失又叫少牙症，全口缺牙又叫无牙症（B对）。（AB均对，故D为本题的正确答案）。